治疗血行瘀滞，多配用补气、行气药，是由于
A. 气能生血
B. 气能行血
C. 气能摄血
D. 血能生气
E. 血能载气

正确答案：B。气能行血

解析：气能生血是指血液的生成必须依赖着气的推动作用和气化作用。临床上治疗血虚的时候，多配伍补气药物，为气能生血理论的具体应用（A错）。气能行血是指血液的正常运行必须依靠着气的推动作用。气滞不能行血，血液停留于局部，形成气滞血瘀，气虚行血无力，引起血液运行迟缓，称为气虚血瘀，在治疗时配以行气、补气药助血运行，是气能行血理论具体应用（B对）。气能摄血是指血液的正常运行必须依赖着气的固摄作用。临床上多用于指导气虚等所致的血行脉外的出血病证的治疗（C错）。血与气的关系为血能养气和血能载气（D错）。血能载气是指气存于血中，依附于血而不致散失，赖血之运载而运行全身（E错）。